在体内水解生成坎利酮的利尿药是
A. 氨茶碱
B. 螺内酯
C. 氢氯噻嗪
D. 盐酸阿米洛利
E. 呋塞米

正确答案：B。螺内酯

解析：本题考查螺内酯的代谢。在体内水解生成坎利酮的利尿药是螺内酯（B对）。螺内酯口服口起效慢，发挥最大疗效需要2～3日。该药半衰期短，但其代谢产物（坎利酮）具有活性，有较长的作用
维持时间（约60h）。氨茶碱（A错）属于磷酸二酯酶抑制剂，在体内释放出茶碱，用作平喘药物。氢氯噻嗪（C错）、盐酸阿米洛利（D错）、呋塞米（E错）均不能水解生成坎利酮。